不属于低分子溶液剂的是
A. 碘甘油
B. 复方薄荷脑醑
C. 布洛芬混悬滴剂
D. 复方磷酸可待因糖浆
E. 对乙酰氨基酚口服溶液

正确答案：C。布洛芬混悬滴剂

解析：本题考查低分子溶剂。布洛芬混悬滴剂（C错，为本题正确答案）属于混悬剂。液体制剂按分散系统分类可分为：低分子溶液剂、高分子溶液剂、溶胶剂、混悬剂、乳剂。碘甘油（A对）、复方薄荷脑醑（B对）、复方磷酸可待因糖浆（D对）、对乙酰氨基酚口服溶液（E对）均为低分子溶液剂。